年龄为7岁的双胞胎兄妹，连续10年监测其骨盆宽和肩宽，计算肩盆宽指数。随着年龄的增长，两人的肩盆宽指数会发生如何变化
A. 哥哥的肩盆宽指数随年龄增加而下降，妹妹的肩盆宽指数随年龄增加而增加
B. 哥哥的肩盆宽指数随年龄增加而增加，妹妹的肩盆宽指数随年龄增加而下降
C. 两人的肩盆宽指数均随年龄增加而增加
D. 两人的肩盆宽指数均随年龄增加而下降
E. 两人的肩盆宽指数均随年龄增加而无变化

正确答案：A。哥哥的肩盆宽指数随年龄增加而下降，妹妹的肩盆宽指数随年龄增加而增加